某医师随机抽取性别、病情严重程度等条件相近的红斑狼疮患者28例，随机等分为两个治疗组。一个疗程后检测dsDNA抗体滴度（倒数）资料如下：抗体滴度（倒数）为阴性时，甲、乙两组各1人；滴度为10时，甲组1人乙组0人；滴度为40时，甲组1人乙组2人；滴度为60时，甲组2人乙组0人；滴度为80时，甲组1人乙组0人；滴度为120时，甲组1人乙组5人；滴度为320时，甲组1人乙组0人；滴度为480时，甲组1人乙组2人；滴度为560时，甲组2人乙组2人；滴度为1240时，甲组1人乙组2人；滴度为1240以上时，甲组2人乙组0人。该资料分析可选用
A. χ²检验
B. 秩和检验
C. t检验
D. Z检验
E. 方差分析

正确答案：B。秩和检验

解析：题中两个样本分别来自方差相等的正态分布总体的假设是不成立的，为等级资料两样本的比较，应采用Wilcoxon秩和检验（B对），其主要目的是比较两样本代表的总体分布位置是否有差别。χ²检验（A错）主要目的是推断两个或多个总体率或构成比之间有无差别。t检验（C错）的应用前提是两个样本分别来自方差相等的正态分布总体的假设成立。Z检验（D错）适用于大样本时两组均数的比较。方差分析（E错）通过计算假设检验的统计量F值，实现对总体均数是否有差别的推断。